某患者，放疗数周后出现中枢神经刺激症状，伴发热38℃，颈强，查脑脊液轻度混浊，淋巴细胞增多，蛋白含量增多。若疑脑脊液中可能存在真菌病原体进行分离培养时，最好使用哪种培养基
A. 血液琼脂培养基
B. 巧克力琼脂培养基
C. 沙氏葡萄糖琼脂
D. 亚碲酸钾培养基
E. 蛋白胨血清培养基

正确答案：C。沙氏葡萄糖琼脂

解析：巧克力培养基：脑膜炎球菌；伊红一美蓝培养基：鉴别大肠杆菌；亚碲酸钾培养基：白喉杆菌；沙氏葡萄糖琼脂培养基：真菌；疱肉培养基：厌氧细菌。掌握“真菌概述及主要病原性真菌”知识点。